诱导肝药酶的药物是
A. 苯巴比妥
B. 双香豆素
C. 庆大霉素
D. 别嘌醇
E. 甲苯磺丁脲

正确答案：A。苯巴比妥

解析：本题考查肝药酶诱导剂。苯巴比妥（A对）能诱导肝药酶，为肝药酶诱导剂。常见的肝药酶诱导剂有苯巴比妥、卡马西平、乙醇（嗜酒慢性中毒者）、利福平、地塞米松等。